以二甲基甲酰胺为溶剂可选择的滴定方法为
A. 非水碱量法
B. 非水酸量法
C. 两者均可
D. 两者均不可

正确答案：B。非水酸量法

解析：本题考查非水溶液滴定法。非水酸量法（B对）以乙二胺或二甲基甲酰胺为溶剂，非水碱量法（ACD错）以冰醋酸或冰醋酸-醋酐为溶剂。